患者，男，46岁。新诊断为高血压，最高血压155/95mmHg，心率100次/分，交感神经兴奋性明显增高，首选的治疗药物是
A. 美托洛尔
B. 氯沙坦
C. 氢氯噻嗪
D. 硝酸甘油
E. 硝苯地平

正确答案：A。美托洛尔

解析：本题考查美托洛尔。首选的治疗药物是美托洛尔（A对）。美托洛尔为β₁受体阻断剂，可通过阻断β肾上腺素受体，降低交感神经活性，减轻由β受体介导的心律失常；对β₂受体影响相对较小。主要用于高血压、心绞痛、心肌梗死、慢性心力衰竭、预防和治疗急性心肌梗死患者的心肌缺血、快速型心律失常和胸痛。氯沙坦（B错）为血管紧张素Ⅱ受体拮抗剂（ARB），可以通过阻断血管紧张素Ⅱ受体，松弛血管平滑肌、对抗醛固酮分泌、减少水钠潴留、阻止成纤维细胞的增殖和内皮细胞凋亡。临床可用于治疗慢性心功能不全、心力衰竭、高血压等。氢氯噻嗪（C错）为噻嗪类利尿药，通过减少血容量而降压，长期用药则通过扩张外周血管而产生降压作用。硝酸甘油（D错）是硝酸酯的代表药，用于防治心绞痛，充血性心力衰竭和心肌梗死，外科手术所诱导的低血压和控制高血压。硝苯地平（E错）能抑制细胞外钙离子内流，导致细胞内钙离子减少，从而松弛血管平滑肌，降低心肌收缩力，降低心肌氧耗、改善心肌供血、保护缺血心肌细胞，用于心绞痛，如变异型心绞痛、不稳定型心绞痛、慢性稳定型心绞痛，高血压（单独或与其他降压药合用）。